医疗机构发生重大医疗事故，主管部门接到报告后应依据《医疗事故处理条例》，立即
A. 逐级报告
B. 组织人员对事故进行调查处理
C. 责令当事人书面检查
D. 赔偿损失
E. 提起诉讼

正确答案：B。组织人员对事故进行调查处理

解析：医疗机构发生重大医疗事故，主管部门接到报告后应依据《医疗事故处理条例》，立即组织人员对事故进行调查处理（B对）。